盐酸-镁粉反应为阴性的有
A. 黄酮
B. 查耳酮
C. 黄酮醇
D. 二氢黄酮
E. 橙酮

正确答案：B、E。查耳酮；橙酮